牙槽嵴组纤维分布于
A. 牙体的四周
B. 牙体的近远中侧
C. 牙体的唇侧
D. 牙体的颊舌侧
E. 牙体舌侧

正确答案：D。牙体的颊舌侧

解析：本题考查牙周膜。牙槽嵴组：起于牙槽嵴顶，呈放射状向牙冠方向走行，止于牙颈部的牙骨质。此纤维存在于颊舌侧（D对），在邻面无此纤维。